结核杆菌感染是结核病的
A. 必要且充分病因
B. 必要非充分病因
C. 充分非必要病因
D. 非必要非充分病因
E. 互补病因

正确答案：B。必要非充分病因

解析：本题考查病因的分类。结核杆菌感染是结核病的必要非充分病因（B对ACDE错）。结核病是传染病，而结核杆菌是其病原体，所以病因分类为必要非充分。